下颌第一磨牙进行种植修复，种植体末端距离下颌管的距离不能少于
A. 1mm
B. 2mm
C. 5mm
D. 6mm
E. 8mm

正确答案：B。2mm

解析：受植区的要求：种植体唇颊、舌腭侧骨质应健康，且厚度不能少于1.5mm，种植体之间以及种植体与自然邻牙之间均不能少于2mm。种植体末端距离下颌管不能少于2mm。一般种植体长度不应少于8～10mm。另外种植体周围存在一定宽度的健康附着牙龈是确保种植义齿修复美学效果的重要因素。掌握“牙种植手术及效果评估”知识点。